药材中含有乳汁管的是
A. 人参
B. 桔梗
C. 白芷
D. 党参
E. 天麻

正确答案：B、D。桔梗；党参

解析：本题考查的是桔梗与党参的显微鉴别。药材中含有乳汁管的是桔梗（B对）、党参（D对）。桔梗【显微鉴别】粉末：黄白色。①乳管常互相连接，直径14～25μm，管中含黄色油滴样颗粒状物。②具梯纹、网纹导管，少有具缘纹孔导管。③菊糖众多（稀甘油装片），呈扇形或类圆形的结晶。党参【显微鉴别】粉末：淡黄色。①石细胞呈方形、长方形或多角形，壁不甚厚。②木栓细胞表面观呈类多角形，垂周壁薄，微弯曲。③菊糖众多，用水合氯醛装片不加热观察，可见菊糖结晶呈扇形，表面现放射状纹理。④节状乳管碎片甚多，含淡黄色颗粒状物，直径16～24μm。⑤网纹导管易察见。人参（A错）【显微鉴别】粉末：淡黄白色。①树脂道碎片易见，内含黄色块状分泌物。②导管多网纹或梯纹，稀有螺纹，直径10～56μm。③草酸钙簇晶直径20～68μm，棱角锐尖。④木栓细胞类方形或多角形，壁细波状弯曲。⑤淀粉粒众多，单粒类球形，半圆形或不规则多角形，复粒由2～6个分粒组成。白芷（C错）【显微鉴别】粉末：黄白色。①油管多破碎，黄色。分泌细胞中含淡黄棕色分泌物；油管碎片旁的细胞中淀粉粒溶化后留有网格样痕迹。②草酸钙簇晶圆簇状或类圆形，直径6～18μm。③导管多为网纹，少为螺纹及具缘纹孔，直径10～85μm。④木栓细胞淡黄棕色，呈类多角形，壁薄、木化。⑤淀粉粒极多，单粒圆球形、椭圆形、多角形或盔帽形，直径3～25μm，脐点十字状、裂缝状、点状、三叉状、人字状或星状，大粒层纹隐约可见；复粒由2～8分粒组成，少数可至12分粒。天麻（E错）【显微鉴别】粉末：黄白色至黄棕色。①厚壁细胞椭圆形或类多角形，直径70～180μm，壁厚3～8μm，木化，纹孔明显。②草酸钙针晶成束或散在，长25～75μm。③薄壁细胞近无色，细胞壁薄，纹孔较明显。④用醋酸甘油装片含糊化多糖类物的薄壁细胞无色，有的细胞可见长卵形、长椭圆形或类圆形颗粒状物质，遇碘液显棕色或淡棕紫色。⑤导管螺纹、网纹及环纹，直径8～30μm。